可摘局部义齿非解剖式人工牙的牙尖斜度是
A. 0°
B. 10°
C. 20°
D. 30°
E. 40°

正确答案：A。0°

解析：非解剖式牙：人工（牙合）面形态与天然牙不同，仅有窝沟而无牙尖，称为无尖牙。掌握“局部义齿人工牙及基托”知识点。